由患者的家长、家属或他人作出求医决定的求医类型是
A. 主动型
B. 被动型
C. 强制型
D. 顾虑型
E. 合作型

正确答案：B。被动型